关于锐性分离的说法错误的是
A. 用于精细的层次解剖或分离粘连坚实的瘢痕组织
B. 使用的器械为锐性的手术刀和手术剪
C. 此法对组织损伤小
D. 动作要求细巧、准确
E. 可在盲视下进行

正确答案：E。可在盲视下进行

解析：本题考查组织分离技术-锐性分离。关于锐性分离的说法错误的是可在盲视下进行（E错，为本题的正确答案）。解剖分离的方法主要有两种：1.锐性分离：用于精细的层次解剖或分离粘连坚实的瘢痕组织（A对），使用的器械为手术刀和手术剪（B对）。此法对组织损伤小（C对），动作要求细巧、准确（D对），一般应在直视下进行。2.钝性分离：用于正常肌肉和疏松结缔组织的分离以及有包膜的良性肿瘤的摘除。主要以血管钳进行，也可使用刀柄、手指、纱布等，可在非直视下进行。对于层次不清又含有重要血管神经的区域，用钝性分离法比较安全，但对组织损伤较大，故操作时更应细致，避免过度用力，以减少组织撕裂伤。